下列哪一个洞形属BlackⅡ类洞
A. 43邻面洞
B. 14邻面洞
C. 15颊侧颈部洞
D. 36颊（牙合）面洞

正确答案：B。14邻面洞

解析：本题考查Black分类法。14邻面洞（B对）属BlackⅡ类洞。按Black窝洞分类法可分为Ⅰ类洞：所有的发育点隙裂沟的龋损所备成的窝洞，包括下颌磨牙的颊面洞和颊（牙合）面洞（D错）等。Ⅱ类洞：后牙邻面的龋损所备的窝洞，包括磨牙和前磨牙的邻面洞等。Ⅲ类洞：前牙邻面未累及切角的龋损所备成的窝洞，包括切牙和尖牙的邻面洞等（A错）。Ⅴ类洞：所有牙齿颊（唇）舌面颈1/3处的龋损所备成的窝洞，包括前牙和后牙颊舌面的颈1/3洞（C错）。